不属于病例-对照研究特点的是
A. 属于观察性研究
B. 设立对照组
C. 可计算发病率
D. 观察方向是“果”到“因”
E. 难以验证因果关系

正确答案：C。可计算发病率

解析：病例对照研究的特点是：①属于观察性研究；②观察方向由“果”及“因”；③可以观察一种疾病与多种因素的关联。掌握“流行病学概论”知识点。